我国2005年颁布的《医疗机构水污染物排放标准》适用对象为
A. 县级及县级以上或20张床位及以上的综合医疗机构和专科医院
B. 地市及地市级以上医疗机构和专科医院
C. 乡镇级以上医疗机构和专科医院
D. 省级以上的医疗机构和专科医院
E. 各级传染病和结核病医院

正确答案：A。县级及县级以上或20张床位及以上的综合医疗机构和专科医院

解析：本题考查我国2005年颁布的《医疗机构水污染物排放标准》的适用对象。《医疗机构水污染物排放标准》中明确了对县级及县级以上或20张床位及以上的综合医疗机构和其他医疗机构（A对BCDE错）污水排放以及传染病、结核病医院的污水中粪大肠菌群数和采用氯化消毒的医院污水中的总余氯作出了具体规定。